下列哪项不是健康促进学校的工作内容
A. 学校健康政策
B. 学校社会和社会环境
C. 学校与社区关系
D. 个人健康技能
E. 学校卫生监督

正确答案：E。学校卫生监督